执业药师资格考试属于
A. 主管药师资格认定考试
B. 职业资格准入考试
C. 检验药学专业技术人员综合知识考试
D. 选拔负责药品质量监督人员资格考试
E. 为药学技术员再就业培训考试

正确答案：B。职业资格准入考试

解析：本题考查执业药师资格考试。执业药师资格考试属于职业资格准入考试（B对）。执业药师资格作为药学技术人员的一种执业资格，充分体现了我国职业资格制度的原则，与其他职业资格制度一样，需要通过执业资格考试。在2017年国家首次公布的《国家职业资格目录》中，将执业药师作为准入类职业资格，纳入国家职业资格目录，是针对药学技术人员的唯一准入类国家职业资格。主管药师资格认定考试（A错）、检验药学专业技术人员综合知识考试（C错）、选拔负责药品质量监督人员资格考试（D错）、为药学技术员再就业培训考试（E错）范围过窄。